服用后可引起多尿，驾驶员应慎用的药物是
A. 氯苯那敏
B. 吲达帕胺
C. 胰酶
D. 阿司匹林
E. 阿托品

正确答案：B。吲达帕胺

解析：本题考查驾驶员用药。服用后可引起多尿，驾驶员应慎用的药物是吲达帕胺（B对）。吲达帕胺服后3h产生利尿作用，4h后作用最强，出现多尿、多汗或尿频。氯苯那敏（A错）可引起嗜睡。阿托品（E错）服用后可致视物模糊。